下列各项，不属于中国古代医德思想内容的是
A. 救死扶伤一视同仁的道德准则
B. 仁爱救人赤诚济世的事业准则
C. 清廉正直不图钱财的道德品质
D. 认真负责一丝不苟的服务态度
E. 不畏权贵忠于医业的献身精神

正确答案：D。认真负责一丝不苟的服务态度

解析：中国古代医德思想包括救死扶伤、一视同仁的道德准则；仁爱救人、赤诚济世的事业准则；清廉正直、不图钱财的道德品质；不畏权贵，忠于医业的献身精神。认真负责、一丝不苟的服务态度为当代医德思想内容的（D错，为本题正确答案）。